孕2月孕妇，平时体健，昨晚始下腹痛伴出血，量多，今日出血仍多并感头晕，眼花，来医院途中昏倒，急救入院，检查：外阴有大量血迹，阴道内积血块，宫颈口开，内可触及软性胚胎组织，宫体2月妊娠大小，面色苍白，血压9.3/7.3kPa，（70/50mmHg），脉搏120次/分估计出血量
A. 100m1
B. 200ml
C. 300ml
D. 400ml
E. ＞500ml

正确答案：E。＞500ml

解析：掌握“自然流产”知识点。